一患者，右下6为死髓牙，经根管治疗后以金属烤瓷冠修复，牙体预备取模型后金属烤瓷冠初戴之前，需要
A. 用金属全冠做保护性修复
B. 制作间隙保持器
C. 不做任何处理
D. 用牙龈保护剂对牙龈进行保护
E. 用塑料全冠做保护性修复

正确答案：E。用塑料全冠做保护性修复

解析：对于牙体预备后的牙齿，最好都是能有临时冠。修复过程中，要制作塑料全冠做保护性修复，避免等待戴牙期间口内组织发生改变，也有利于牙面的清洁。此处塑料全冠有两种作用：①保护预备后的牙体，防止其变形或者损伤，死髓牙特别容易缺损破坏，这是主要作用；②美观作用，这是次要因素。掌握“烤瓷熔附金属冠”知识点。